患者，男性，57岁，嗜烟约35年。慢性咳嗽咳痰10余年，进行性气促加重2年，被诊断为慢性支气管炎、阻塞性肺气肿，其X线胸片不会出现下列哪项
A. 早期正常无明显变化，中、晚期可见肺纹理增加、粗乱
B. 合并感染时有支气管周围炎症改变
C. 合并感染时有支气管柱状扩张，肺纹理蜂窝状改变
D. 肺容量增大，肋间隙增宽，膈肌低平
E. 心脏悬垂并狭长

正确答案：C。合并感染时有支气管柱状扩张，肺纹理蜂窝状改变

解析：C项为支气管扩张的典型X线胸片表现，而不是慢支炎、肺气肿的X线胸片表现，其余各项均是正确的。A、B两项主要为慢性支气管炎的X线胸片表现，D、E两项主要为阻塞性肺气肿的X线胸片表现。掌握“支气管扩张”知识点。